有两名糖尿病患者在服用了某甲药厂生产的批号为081101的“糖脂宁胶囊”后出现死亡，经检验部门检查，该药厂并未生产批号为081101的“糖脂宁胶囊”，而生产者为乙企业，经检验，乙企业在糖脂宁胶囊中添加了格列本脲，则下列说法中正确的有
A. 批号为081101的药品为假药
B. 乙企业生产销售假药罪，追究其刑事责任
C. 甲、乙企业同时按生产销售劣药罪论处
D. 甲生产企业应当召回其生产的所有“糖脂宁胶囊”
E. 甲企业应当召回涉案的批号为081101“糖脂宁胶囊”

正确答案：A、B。批号为081101的药品为假药；乙企业生产销售假药罪，追究其刑事责任

解析：本题考查假药的界定。有两名糖尿病患者在服用了某甲药厂生产的批号为081101的“糖脂宁胶囊”后出现死亡，经检验部门检查，该药厂并未生产批号为081101的“糖脂宁胶囊”，而生产者为乙企业，经检验，乙企业在糖脂宁胶囊中添加了格列本脲，则下列说法中正确的有批号为081101的药品为假药（A对）、乙企业生产销售假药罪，追究其刑事责任（B对）。《药品管理法》第九十八条第一款、第二款规定，禁止生产（包括配制，下同）、销售、使用假药。有下列情形之一的，为假药：①药品所含成分与国家药品标准规定的成分不符；②以非药品冒充药品或者以他种药品冒充此种药品；③变质的药品；④药品所标明的适应症或者功能主治超出规定范围。根据《刑法》第一百四十一条规定，生产、销售假药的，处三年以下有期徒刑或者拘役，并处罚金；对人体健康造成严重危害或者有其他严重情节的，处三年以上十年以下有期徒刑，并处罚金；致人死亡或者有其他特别严重情节的，处十年以上有期徒刑、无期徒刑或者死刑，并处罚金或者没收财产。